性平，能明目去翳的药是
A. 硼砂
B. 升药
C. 炉甘石
D. 大蒜
E. 猫爪草

正确答案：C。炉甘石

解析：本题考查的是炉甘石的性味归经与功效。性平，能明目去翳的药是炉甘石（C对）。炉甘石：【性味归经】甘，平。归肝、脾经。【功效】明目去翳，收湿生肌。硼砂（A错）：【性味归经】甘、咸，凉。归肺、胃经。【功效】外用清热解毒，内服清肺化痰。升药（B错）：【性味归经】辛，热。有大毒。归肺、脾经。【功效】拔毒去腐。大蒜（D错）：【性味归经】辛，温。归脾、胃、肺经。【功效】解毒，消肿，杀虫，止痢。猫爪草（E错）：【性味归经】甘、辛，温。归肝、肺经。【功效】化痰散结，解毒消肿。